根据《中华人民共和国药品管理法》，生产药品所需的原料、辅料必须符合
A. 食用标准
B. 行业标准
C. 药用要求
D. 卫生要求
E. 生产要求

正确答案：C。药用要求

解析：本题考查药品生产。根据《中华人民共和国药品管理法》，生产药品所需的原料、辅料必须符合药用要求（C对）。《中华人民共和国药品管理法》第四章药品生产第四十五条：生产药品所需的原料、辅料，应当符合药用要求、药品生产质量管理规范的有关要求。生产药品，应当按照规定对供应原料、辅料等的供应商进行审核，保证购进、使用的原料、辅料等符合前款规定要求。药品标准分为法定标准和非法定标准两种。法定标准是包括中国药典在内的国家药品标准和经国务院药品监督管理部门核准的药品质量标准；非法定标准有行业标准（B错）、团体标准、企业标准等。法定标准属于强制性标准，是药品质量的最低标准，拟上市销售的任何药品都必须达到这个标准；企业标准只能作为企业的内控标准，各项指标均不得低于国家药品标准。医疗机构用于调配药品的工具、设施、包装用品以及调配药品的区域，应当符合卫生要求（D错）及相应的调配要求。麻醉药品和精神药品的定点生产企业应当具有与麻醉药品和精神药品安全生产要求（E错）相适应的管理水平和经营规模。